临床判断龋质是否去净，主要依据
A. 硬度
B. 色泽
C. 有无敏感点
D. A+B
E. B+C

正确答案：D。A+B

解析：本题考查临床判断龋质是否去净的依据。临床上判断龋坏组织是否去净，主要依据其硬度和色泽（D对）。慢性龋时，有修复性牙本质形成，该修复性牙本质颜色较深，质硬，应予以保留；急性龋时，病变进展快，脱矿层较厚，着色较浅，临床上很难根据色泽判断龋坏组织是否去净。有无敏感点（CE错）可以判断龋坏的深度。